关于低位肠梗阻，正确的是
A. 腹胀、腹痛不明显
B. 呕吐物多为胃内容物
C. 梗阻多位于空肠
D. 呕吐症状早
E. X线腹透见腹部数个阶梯状含气液平面

正确答案：E。X线腹透见腹部数个阶梯状含气液平面

解析：低位肠梗阻是指任何原因引起的回肠、结肠和直肠肠腔（C错）内容物通过障碍，是常见的急腹症之一。腹胀、腹痛不明显为高位肠梗阻的表现，低位小肠梗阻的腹胀腹痛症状明显（A错）；呕吐物多为胃内容物为高位性肠梗阻的表现，低位小肠梗阻呕吐物初期为胃内容物，后期为粪样物（B错）；呕吐症状早为高位肠梗阻的表现，低位肠梗阻呕吐出现晚而次数少（D错）；X线腹透见腹部数个阶梯状含气液平面为低位肠梗阻X线检查的表现（E对）。